静脉注入甘露醇后尿量增多的原因是
A. 小管液渗透压升高，水和KCl的重吸收增加
B. 小管液渗适压升高，水和NaCl的重吸收增加
C. 小管液渗透压升高，水和NaCl的重吸收减少
D. 小管液渗透压降低，水和KCI的重吸收减少
E. 小管液渗透压降低，水和NaCl的重吸收增加

正确答案：C。小管液渗透压升高，水和NaCl的重吸收减少